队列研究的结果比病例对照研究结果可靠，其主要是因为
A. 时间顺序合理
B. 时间顺序不合理
C. 研究对象选择代表性好
D. 研究对象选择不合理

正确答案：A。时间顺序合理

解析：本题考查队列研究的优点。队列研究由于病因发生在前，疾病发生在后，因果现象发生的时间顺序是合理的（A对BCD错），加之偏倚较少，又可直接计算各项测量疾病危险强度的指标，故其检验病因假说的能力较强，一般可证实病因联系。